初产妇，38周，宫缩30s/7-8分钟，骨盆正常、头位，胎心率150次/分，S+3，羊水三度浑浊，如何处理
A. 剖宫产
B. 产钳助产
C. 继续观察
D. 静滴缩宫素
E. 胎头吸引

正确答案：B。产钳助产

解析：患者初产妇，38周，宫缩30s/7-8分钟，骨盆正常、头位，胎心率150次/分（正常胎心率基线110～160/分），S+3（提示胎头已下降至坐骨棘平面以下3cm），羊水三度浑浊，结合患者的表现，应行产钳助产（B对）。